B级）患者的推荐起始剂量为每次50mg，每天两次。在患者能够耐受的情况下，可以每2～4周倍增一次本品剂量，直至达到目标维持剂量每次200mg，每天两次。关于沙库巴曲缬沙坦的使用注意事项，错误的是
A. 沙库巴曲缬沙坦钠不能与阿替洛尔、吲哚美辛或西咪替丁合用
B. 从ACEI转换为沙库巴曲缬沙坦时，应停用ACEI36小时后方可转换
C. 轻、中度肾功能不全患者可使用沙库巴曲缬沙坦
D. 轻、中度肝功能损害患者可使用沙库巴曲缬沙坦
E. 孕中、晚期妇女禁用沙库巴曲缬沙坦

正确答案：A。沙库巴曲缬沙坦钠不能与阿替洛尔、吲哚美辛或西咪替丁合用

解析：本题考查沙库巴曲缬沙坦。题目中【药物相互作用】：在合用保钾利尿剂(例如，氨苯蝶啶、阿米洛利）、盐皮质激素受体拮抗剂(如依普利酮）、钾补充剂或高钾食盐时，可能会导致血清钾升高以及血肌酐升高。沙库巴曲缬沙坦合用呋塞米、地高辛、华法林、氢氯噻嗪、氨氯地平、奥美拉唑、卡维地洛、左炔诺孕酮/炔雌醇复方制剂或静脉用硝酸甘油时，没有观察到具有临床意义的药物相互作用。通过上述内容可预计沙库巴曲缬沙坦与阿替洛尔、吲哚美辛、格列本脲或西咪替丁之间也不存在相互作用（A错，为本题正确答案）。从ACEI转换为沙库巴曲缬沙坦时，应停用ACEI36小时后方可转换（B对）。轻、中度肾功能不全患者可使用沙库巴曲缬沙坦（C对）。轻、中度肝功能损害患者可使用沙库巴曲缬沙坦（D对）。孕中、晚期妇女禁用沙库巴曲缬沙坦（E对）。